古蔡氏砷盐检查法中，醋酸铅棉花的作用是
A. 还原五价的砷成三价的砷
B. 氧化三价的砷成五价的砷
C. 产生新生态的氧
D. 吸收产生的硫化氢气体
E. 吸收产生的氢气

正确答案：D。吸收产生的硫化氢气体

解析：本题考查古蔡氏砷盐检查法。样品中可能含有少量硫化物，在酸性溶液中生成硫化氢气体，醋酸铅棉花即可吸收硫化氢气体（D对）。